说肺为娇脏的主要依据是
A. 肺主一身之气
B. 肺外合皮毛
C. 肺朝百脉
D. 肺为水之上源
E. 肺气通于天，不耐寒热

正确答案：E。肺气通于天，不耐寒热

解析：肺为娇脏，是对肺的生理病理特征的概括，是指肺叶娇嫩，不耐寒热燥湿诸邪侵袭并且易受外邪侵袭。肺主一身之气是指肺有主司一身之气的生成和运行的作用（A错）。肺外合皮毛，是指肺与皮毛的相互为用关系，是指生理上肺输精于皮毛，滋养皮毛，而皮毛助肺呼吸，保护肺（B错）。肺朝百脉指的是全身气血均通过经脉朝会于肺，达到气体交换和助心行血的作用（C错）。肺为水之上源是指肺为华盖，位于人体的上焦，参与调节全身水液代谢（D错）。肺气通于天，不耐寒热，是指肺通过口鼻与外界相通，自然界寒、热、燥、湿等邪气易侵犯肺脏。肺为清虚之体，性喜清润，不耐寒热，不容异物，是肺为娇脏的主要依据（E对）。